某小儿，2个月。足月顺产，母乳喂养，为预防佝偻病服用维生素D，每日补充的合理剂量是
A. 200IU
B. 400IU
C. 2000IU
D. 5000IU
E. 10000IU

正确答案：B。400IU

解析：维生素D缺乏性佝偻病是小儿体内维生素D不足致使钙磷代谢紊乱，产生的一种以骨骼病变为特征的全身慢性营养性疾病，为预防本病，足月儿出生2周后开始补充维生素D400IU/d，补充至2岁（B对）。2000IU（C错）属于治疗剂量。